种植义齿主要由
A. 基台
B. 螺丝
C. 修复体
D. 种植体
E. 以上均包括

正确答案：E。以上均包括

解析：种植义齿的组成：种植义齿主要由种植体、基台、螺丝和修复体组成。掌握“种植义齿的组成和修复治疗原则”知识点。